合理用药的有效性的含义之一是
A. 针对所用药物或出现意外情况，建议采取相应措施
B. 使患者用药后迅速达到预期目的
C. 药物的使用时间应尽量缩短
D. 控制医疗保健费用的过度增长
E. 药物的使用方法便于医生和患者掌握

正确答案：B。使患者用药后迅速达到预期目的